翼下颌间隙感染一般不会累及
A. 眶下间隙
B. 颞下间隙
C. 咽旁间隙
D. 颊间隙
E. 咬肌间隙

正确答案：A。眶下间隙

解析：本题考查间隙感染。翼下颌间隙感染一般不会累及眶下间隙（A错，为本题正确答案）。翼下颌间隙感染常见为下颌智齿冠周炎及下颌磨牙根尖周炎症扩散所致；下牙槽神经阻滞麻醉时消毒不严或拔下颌第三磨牙时创伤过大，也可引起翼下颌间隙感染；此外，相邻间隙，如颞下间隙（B对）、咽旁间隙（C对）、颊间隙（D对）、咬肌间隙（E对）炎症也可波及。